若扭转牙需全冠修复，需磨除牙体组织过多，在修复前应
A. 安抚
B. 直接充填
C. 间接充填
D. 根管治疗
E. 根尖诱导成形术

正确答案：D。根管治疗

解析：错位、扭转或过长牙，义齿修复需要大量磨改牙冠，可能累及牙髓，应行根管治疗术。掌握“根管治疗术概述”知识点。